淋病奈瑟菌的形态特点是
A. 革兰阳性链球菌
B. 革兰阴性球
C. 革兰阴性螺形菌
D. 革兰阳性四联球菌
E. 革兰阴性双球菌

正确答案：E。革兰阴性双球菌

解析：淋病奈瑟菌是革兰阴性双球菌（E对）。